属于真性肿瘤的是
A. 动静脉畸形
B. 微静脉畸形
C. 淋巴管畸形
D. 混合畸形
E. 血管瘤

正确答案：E。血管瘤

解析：肿瘤性病变中只有血管瘤为真性肿瘤，其他均属脉管畸形。掌握“血管瘤与脉管畸形”知识点。